牙震荡几个月后仍有反应的牙髓，大多数能继续保持活力
A. 一个月
B. 三个月
C. 六个月
D. 八个月
E. 一年

正确答案：B。三个月

解析：牙震荡3个月后仍有反应的牙髓，则大多数能继续保持活力。掌握“牙震荡”知识点。